根据《处方药与非处方药分类管理办法（试行）》，非处方药标识可以采取单色印刷的是
A. 标签和内包装
B. 说明书和大包装
C. 标签和说明书
D. 内包装和大包装
E. 标签和大包装

正确答案：B。说明书和大包装

解析：本题考查非处方药专有标识的管理。根据《处方药与非处方药分类管理办法（试行）》，非处方药标识可以采取单色印刷的是说明书和大包装（B对）。使用非处方药专有标识时，药品的使用说明书和大包装可以单色印刷，标签和其他包装（ACDE错）必须按照国家药品监督管理局公布的色标要求印刷。